反映药物吸收程度的是
A. 血药浓度-时间曲线下面积
B. 半衰期
C. 达峰时间
D. 峰浓度
E. 表观分布容积

正确答案：A。血药浓度-时间曲线下面积

解析：本题考查药动学参数。血药浓度-时间曲线下面积（A对）代表一次用药后的吸收总量，反映药物的吸收程度；半衰期（B错）是指血药浓度下降一半所需的时间；达峰时间（C错）指单次服药以后，血药浓度达到峰值的时间；峰浓度（D错）指给药后达到的最高血药浓度；表观分布容积（E错）是指药物在体内达到动态平衡时，体内药量与血药浓度的比值，是一个比例常数，反映药物体内分布的广泛程度或药物与组织结合的程度。